有关腹股沟管的描述，错误的是
A. 在腹股沟韧带内侧半上方
B. 长约4~5cm
C. 内口为腹股沟管腹环
D. 前壁为腹内斜肌和腹横肌的起始部
E. 无

正确答案：D。前壁为腹内斜肌和腹横肌的起始部

解析：腹股沟管在腹股沟韧带内侧半上方（A对），长约4～5cm（B对），内口为腹股沟管腹环（C对），前壁为腹外斜肌和腹内斜肌，而非腹内斜肌和腹横肌（D错，为本题正确答案）。